营养乳腺的是
A. 椎动脉
B. 颈内动脉
C. 面动脉
D. 胸廓内动脉
E. 肺动脉

正确答案：D。胸廓内动脉

解析：胸廓内动脉（D对）为营养乳腺、胸前壁、心包和膈等处的动脉。